知觉自己有可能成为该疾病或危险因素的受害者，是导致健康相关行为改变的心理活动的哪个因素
A. 危害性
B. 易感性
C. 效益
D. 障碍
E. 自我效能

正确答案：B。易感性